对鉴别上、下尿路感染最有意义的是
A. 中段尿细菌培养阳性
B. 尿路刺激症状
C. 畏寒、发热、腰痛
D. 血尿
E. 尿中白细胞管型

正确答案：E。尿中白细胞管型

解析：本题考查急性肾孟肾炎、尿路结石及慢性肾衰竭。畏寒、发热、腰痛和尿中白细胞管型都属于有意义的鉴别，选择最佳的选项应该是尿中白细胞管型（E对）。